甲亢治疗时粒细胞减少多见于
A. 放射性核素¹³¹Ⅰ治疗后
B. 复方碘溶液治疗后
C. 抗甲状腺药物治疗后
D. 甲状腺次全切除术后
E. 甲状腺素治疗后

正确答案：C。抗甲状腺药物治疗后